关于皮质脊髓侧束的描述,正确的是
A. 为同侧大脑皮质运动区来的纤维
B. 位于脑桥被盖部
C. 位于脊髓的侧索内
D. 仅见于脊髓的颈、胸段
E. 此束损伤时出现下运动神经元瘫痪症状

正确答案：C。位于脊髓的侧索内

解析：皮质脊髓侧束为对侧大脑皮质运动区来的纤维（A错），位于延髓椎体的下端（B错）。皮质脊髓侧束在脊髓外侧索后部下行（C对），直至骶髓（D错）。此束受损导致同侧下肢运动瘫痪（E错）。